患者男，45岁，近来出现心动过速。查体：心率为150次/分，率规则，按压颈动脉窦后，心率突然减慢到90次/分，但运动后又增快至150次/分。首先应考虑的诊断为
A. 阵发性室性心动过速
B. 阵发性室上性心动过速
C. 阵发性房性心动过速伴2：1房室传导阻滞
D. 心房扑动，2：1房室传导阻滞
E. 窦性心动过速

正确答案：B。阵发性室上性心动过速

解析：按压颈动脉窦时，压力感受器兴奋增强，窦神经及主动脉神经传入延髓心血管中枢的冲动增多，从而使心交感中枢和缩血管中枢紧张性降低，心迷走神经的紧张性增高，于是由心交感神经传出的冲动减少，心迷走神经传出的冲动增多，结果使心率减慢，心动过速可缓解。（B对）。室性心动过速：①3个或以上的室早连续出现QRS波群，T波方向与QRS主波方向相反。②常没有P波，如有P波，则P波与QRS波群之间无固定关系，且P波频率比QRS波频率缓慢。③室性心动过速频率大多数为每分钟140～220次，室律可略有不齐。④偶可发生心室夺获或室性融合波（A错）。阵发性房性心动过速多见于伴有器质性心脏病的患者。IART发作时有心悸、胸闷等症状。发作时心率可为100～150次/min，也可达160～200次/min。发作呈突发、突止的特点，个别可呈慢性持续过程。心动过速发作间隔时间不定，可间隔几秒、几小时、数天、数周甚至数年发作一次（C错）。心房扑动：①P波消失，代之以连续性锯齿样扑动波（或称F波），各波大小、形态相同，频率规则，为240～350次/分。大多不能全都下传，常以固定房室比例（2:1或3:1-5:1）下传，心室率不规则。。②QRS波群及T波均呈正常形态，但偶尔可因室内差异性传导、合并预激症候群或伴束支传导阻滞，其增宽并畸形。2:1房室传导阻滞，部分心房激动不能传至心室，一些P波后没有QRS波群（D错）。窦性心动过速指窦房结发出的激动超过了100次/min以上（E错）。